用氢氧化钠滴定液（0.1000mol/L）滴定20.00ml盐酸溶液（0.1000mol/L），滴定突跃范围的pH值是
A. 1.00～3.00
B. 3.00～4.30
C. 4.30～9.70
D. 8.00～9.70
E. 9.70～10.00

正确答案：C。4.30～9.70